中央性前置胎盘大出血的治疗方法哪项是正确的
A. 如为臀位，行足牵引
B. 催产素引产
C. 胎头吸引助产
D. 剖宫产
E. 人工破膜，头皮钳牵引压迫止血

正确答案：D。剖宫产

解析：中央性前置胎盘指胎盘组织完全覆盖宫颈内口，又合并大出血，需以剖宫产来结束分娩。掌握“前置胎盘”知识点。